细菌内毒素的特征
A. 只有革兰阴性细菌产生
B. 少数革兰阴性细菌产生
C. 细菌在生活状态下释放
D. 抗原性强
E. 不耐热

正确答案：A。只有革兰阴性细菌产生

解析：掌握“医院感染及细菌的致病性”知识点。